连续用药较长时间，药效逐渐减弱，需加大剂量才能出现药效的现象称为
A. 耐受性
B. 耐药性
C. 成瘾性
D. 快速耐受性
E. 习惯性

正确答案：A。耐受性

解析：本题考查药物耐受性。连续用药较长时间，药效逐渐减弱，需加大剂量才能出现药效的现象称为耐受性（A对）。耐受性是指在连续用药过程中，有的药物的药效会逐渐减弱，需加大剂量才能显效的现象。耐药性（B错）系指在化学治疗中，病原体或肿瘤细胞对化疗药物的敏感性降低的现象。成瘾性（C错）又称精神依赖性，是指多次用药后使人产生欣快感，导致用药者在精神上对所用药物有一种渴求连续不断使用的强烈欲望，继而引发强迫用药行为，以获得满足和避免不适感。快速耐受性（D错）是指有些药物在短时间内重复给予而使机体反应减弱，最后虽然剂量加得很大也不能得到原来的反应。习惯性（E错）是指患者长期用药后对药物产生精神上的依赖，停药后患者主观感觉不舒服、不习惯，并不出现客观上的体征表现。